下列哪项症状表示发生地方性砷中毒
A. 四肢皮肤色素沉着
B. 骨硬化和骨质疏松
C. 智力低下
D. 甲状腺肿大
E. 骨疼痛

正确答案：A。四肢皮肤色素沉着

解析：本题考查慢性砷中毒的症状。地方性砷中毒是由于长期自饮用水、室内煤烟、食物等环境介质中摄入过量的砷而引起的一种生物地球化学性疾病。临床上以末梢神经炎、皮肤色素代谢异常（A对BCDE错）、掌跖部皮肤角化、肢端缺血坏疽、皮肤癌变为主要表现，是一种伴有多系统、多脏器受损的慢性全身性疾病。